三级信息源的优点是
A. 内容广泛，使用方便
B. 内容准确，没有偏倚
C. 内容更新快速准确
D. 作者转录数据准确
E. 提供内容全面细致

正确答案：A。内容广泛，使用方便

解析：本题考查三级信息的优点。三级信息源的优点：①对一个具体的问题提供的信息全面细致或简明扼要。②内容广泛，使用方便（A对）。③有的还提供疾病与药物治疗的基础知识。